掌跖角化-牙周破坏综合征病理特点是
A. 牙周袋壁有明显的慢性炎症
B. 破骨细胞活动明显，成骨活动少
C. 主要为浆细胞浸润
D. 患牙根部的牙骨质非常薄
E. 以上均是

正确答案：E。以上均是

解析：本题考查掌跖角化-牙周破坏综合征的病理特点。掌跖角化-牙周破坏综合征是一种常染色体隐性遗传病，其病理特点有：牙周袋有明显的慢性炎症（A对），主要为浆细胞浸润（C对），袋壁上皮内几乎见不到中性多形核白细胞。破骨活动明显，成骨活动很少（B对），牙槽骨吸收严重。患牙根部的牙骨质非常薄（D对），有时仅在根尖区存在较厚的有细胞的牙骨质。X线片见牙根细而尖，表明牙骨质发育不佳。（ABCD均对，故E为本题的正确答案）。